有关牙本质说法正确的是
A. 色白色、没有弹性、硬度比釉质低、比骨组织略高
B. 色淡黄、稍有弹性、硬度比釉质高、比骨组织略低
C. 色淡黄、没有弹性、硬度比釉质低、比骨组织略高
D. 色淡黄、稍有弹性、硬度比釉质低、比骨组织略高
E. 色白色、没有弹性、硬度比釉质高、比骨组织略低

正确答案：D。色淡黄、稍有弹性、硬度比釉质低、比骨组织略高

解析：牙本质构成牙齿的主体。牙本质色淡黄，稍有弹性，硬度比釉质低，比骨组织略高。掌握“牙本质”知识点。